关于前列腺的叙述，错误的是
A. 不成对
B. 为一实质性器官
C. 由腺组织和平滑肌组成
D. 一般可分为5叶
E. 前面有前列腺沟

正确答案：E。前面有前列腺沟

解析：前列腺是单个（A对）的实质性器官，不成对。前列腺是由腺组织和平滑肌（C对）组织构成的实质性器官（B对）。前列腺分为五叶（D对）：前叶、中叶、后叶和两侧叶。前列腺体的后面（E错，为本题正确答案）平坦，中间有一纵行浅沟，称前列腺沟。